慢性乙型肝炎干扰素治疗的疗程是
A. 小于6周
B. 8～12周
C. 24周
D. 1年
E. 2年以上

正确答案：D。1年

解析：慢性乙型肝炎干扰素治疗方案：普通干扰素每周3次，疗程半年，根据病情可延长至1年；长效干扰素每周1次，疗程1年，故慢性乙型肝炎干扰素治疗的疗程是1年（D对）。